上下牙弓（牙合）面接触最广，牙尖相互交错的位置不是
A. 正中（牙合）位
B. 牙尖交错位
C. 正中关系位
D. 最广泛接触位
E. 牙位

正确答案：C。正中关系位

解析：本题考查颌位-牙尖交错位。上下牙弓（牙合）面接触最广，牙尖相互交错的位置不是正中关系位（C错，为本题的正确答案）。正中关系位为正中（牙合）位的最后位，此时髁突受颞下颌韧带水平纤维的限制，不能再向后退，故又称后退接触位。上下牙弓（牙合）面接触最广，牙尖相互交错的位置为牙尖交错位（B对），过去曾称正中（牙合）位（A对），又称最广泛接触位（D对）、牙位（E对）。